产品上市需要办理备案手续，经营不需要备案和许可手续的是
A. 第二类医疗器械
B. 第一类医疗器械
C. 第三类医疗器械
D. 特殊用途医疗器械

正确答案：B。第一类医疗器械

解析：本题考查医疗器械注册与经营。产品上市需要办理备案手续，经营不需要备案和许可手续的是第一类医疗器械（B对）。医疗器械的产品注册与备案管理：第一类医疗器械实行产品备案管理。第二类（A错）、第三类医疗器械（C错）实行产品注册管理。医疗器械经营分类管理要求：按照医疗器械风险程度，医疗器械经营实施分类管理。经营第一类医疗器械不需许可和备案，经营第二类医疗器械实行备案管理，经营第三类医疗器械实行许可管理。